女性，45岁，血性白带2个月，妇检阴道未受肿瘤侵犯，宫颈菜花样，宫体正常大小，宫旁明显增厚，癌肿未达盆腔，宫颈活检为鳞癌，其分期是
A. ⅠB期
B. ⅠC期
C. ⅡA期
D. ⅡB期
E. ⅢA期

正确答案：D。ⅡB期

解析：该患者为中年女性，出现血性白带，妇检：阴道未受肿瘤侵犯，宫颈菜花样，宫体正常大小，宫旁明显增厚，癌肿未达盆腔（ⅡB期 有明显宫旁浸润，但未达到盆壁），宫颈活检为鳞癌，应诊断为宫颈癌Ⅱb期（D对）。子宫颈癌临床分期：（1）Ⅰ期 肿瘤局限在子宫颈（扩展至宫体将被忽略）。ⅠA 镜下浸润癌（所有肉眼可见的病灶，包括表浅浸润，均为ⅠB期），间质浸润深度＜5mm，宽度≤7mm；ⅠA1 间质浸润深度≤3mm，宽度≤7mm；ⅠA2间质浸润深度＞3mm且＜5mm，宽度≤7mm。ⅠB期（A错） 临床癌灶局限于子宫颈，或者镜下病灶＞ⅠA；ⅠB1 临床癌灶≤4cm；ⅠB2 临床癌灶＞4cm。（2）Ⅱ期 肿瘤超越子宫，但未达骨盆壁或未达阴道下1/3。ⅡA（C错） 肿瘤侵犯阴道上2/3，无明显宫旁浸润；ⅡA1 临床可见癌灶≤4cm；ⅡA2临床可见癌灶＞4cm。ⅡB期（D对） 有明显宫旁浸润，但未达到盆壁。（3）Ⅲ期 肿瘤已扩展到骨盆壁，在直肠指诊时，在肿瘤和盆壁之间无间隙。肿瘤累及阴道下1/3，由肿瘤引起的肾盂积水或肾无功能的所有病例，除非已经知道由其他原因所引起。ⅢA（E错） 肿瘤累及阴道下1/3，没有扩展到骨盆壁。ⅢB 肿瘤扩展到骨盆壁，或引起肾盂积水或肾无功能。（4）Ⅳ期 肿瘤超出了真骨盆范围，或侵犯膀胱和（或）直肠黏膜。ⅣA 肿瘤侵犯邻近的盆腔器官。ⅣB 远处转移。无ⅠC期（B错）分期。